有关髋关节结核描述的正确的是
A. 多见于儿童
B. 双侧发病较多
C. 不会形成寒性脓肿
D. “4”字试验阴性
E. 髋关节缺血性坏死

正确答案：A。多见于儿童

解析：髋关节结核多见于儿童（A对），单侧发病者居多（B错），病人后期可出现结核病特有的寒性脓肿（C错）和病理性脱位，“4”字试验（D错）、髋关节过伸试验、托马斯征均可出现阳性体征，一般不影响髋关节血液供应，不易引起髋关节缺血性坏死（E错）。